吸水性较大且可以提高油脂性软膏药物渗透性的物质是
A. 氢化可的松
B. 羊毛脂
C. 凡士林
D. 液体石蜡
E. 硅油

正确答案：B。羊毛脂

解析：本题考查的是油脂性基质的代表品种及应用。吸水性较大且可以提高油脂性软膏药物渗透性的物质是羊毛脂（B对）。羊毛脂：又称无水羊毛脂，为淡黄色黏稠半固体，熔点36℃～42℃，因含胆甾醇、异胆甾醇与羟基胆甾醇及其酯而有较大的吸水性，可吸水150%、甘油140%、70%的乙醇40%。由于羊毛脂的组成与皮脂分泌物相近，故可提高软膏中药物的渗透性。常与凡士林合用，调节凡士林的渗透性和吸水性。凡士林（C错）：系液体与固体烃类形成的半固体混合物。具有适宜的稠度和涂展性，且对皮肤与黏膜无刺激性。性质稳定，不酸败，可与大多数药物配伍。油腻性大而吸水性较差（仅能吸水5%），故不宜用于有多量渗出液的患处。但与适量的羊毛脂、鲸蜡醇或胆甾醇等合用，可增加其吸水性。加入适量的表面活性剂可改善药物的释放与穿透性。液体石蜡（D错）：是多种液体烃的混合物，能与多数脂肪油或挥发油混合。主要用于调节软膏稠度，液状石蜡还可用以研磨药物粉末，使易于基质混匀。硅油（E错）：具有良好的润滑作用，易于涂布，能与羊毛脂、硬脂醇、鲸蜡醇、硬脂酸甘油酯等混合。因此常用于乳膏剂，也可与其他油脂类基质合用制成防护性软膏。氢化可的松（A错），2022年考试指南未明确说明。